在牙齿萌出过程中，牙齿进入口腔之前，牙冠表面覆盖的结构是
A. 马拉瑟上皮剩余
B. 牙龈上皮
C. Serre上皮剩余
D. 缩余釉上皮
E. 釉小皮

正确答案：D。缩余釉上皮

解析：在颌骨内，牙根逐渐形成后，牙齿进入口腔之前，牙冠表面给缩余釉上皮覆盖，此结构能够保护牙冠在萌出移动中不受损伤。若没有此结构，釉质和牙本质可在移动的过程中被吸收导致牙冠变性。掌握“牙体、牙周组织的形成”知识点。